在儿童铁缺乏的铁减少期，血生化改变是
A. 血清铁下降
B. 血红蛋白下降
C. 血清铁蛋白下降
D. 血细胞比容下降
E. 总铁结合力上升

正确答案：C。血清铁蛋白下降